男孩，2岁。发热4天，体温达40度，流涕，鼻塞，咳嗽，咽部充血，颈部出现散在红色丘疹，口唇颊膜可见白色斑点。该患者的诊断是
A. 风疹
B. 麻疹
C. 幼儿急疹
D. 水痘
E. 猩红热

正确答案：B。麻疹

解析：典型麻疹（B对）前驱期常持续3～4天。多有中度以上，热型不一的发热。发热同时出现咳嗽、喷嚏、咽部充血等上呼吸道感染症状，及结合膜充血、流泪、畏光等结膜炎表现。出疹前1～2天时，可见于下磨牙相对的颊黏膜上，为直径0.5～1mm的灰白色小点，即麻疹黏膜斑（Koplik斑），直到出疹后1～2天消失。皮疹先出现于耳后、发际，渐及额面、颈部。风疹（七版诸福棠实用儿科学P733）（A错）一般1～2天即出现皮疹，幼儿急疹（七版诸福棠实用儿科学P738）（C错）部分患儿软腭可出现特征性红斑（Nagayama’s spots），而非口唇颊膜白色斑点。水痘（P174）（D错）一般1～2天即出现皮疹，最初的皮疹为红色斑疹和丘疹，继之变为透明饱满的水泡。猩红热（九版传染病学P203）（E错）除了高热、咽峡炎表现以外，咽部有脓性渗出液。另外猩红热一般于发热后第2天即开始出疹。